艾滋病的健康教育，“增加教育的覆盖面”属于艾滋病健康教育
A. 治“标”措施
B. “标”“本”兼治措施
C. 治“本”措施
D. 消除社会歧视措施
E. 以上均不正确

正确答案：C。治“本”措施